社会病防治的基本措施
A. 积极开展全民健康教育
B. 加强对社会病的社会控制
C. 充分发挥家庭的作用
D. 建立社会病的咨询与治疗机构，进行危机干预
E. 以上全是

正确答案：E。以上全是